关于药品安全风险和药品安全风险管理措施的说法，错误的是
A. 药品内在属性决定药品具有不可避免的药品安全风险
B. 不合理用药，用药差错是导致药品安全风险的关键因素
C. 药品上市许可人应担负起药品整个生命周期的安全监测和风险管理工作
D. 实施药品安全风险管理的有效措施是要从药品注册环节消除各种药品风险因素

正确答案：D。实施药品安全风险管理的有效措施是要从药品注册环节消除各种药品风险因素

解析：本题考查的是药品安全与风险管理。药品安全是一个相对的概念，取决于上市前对药品安全评价的认知局限性，也取决于对药品风险与收益量化评价的艰难性。药品安全相对性体现在整个药品的研发过程中。在这个过程中，不追求“零风险”，而要求对风险的有效控制，使其控制在可接受的范围内（D错，为本题正确答案）。药品安全与风险管理：药品产业链长，有研发、生产、流通和使用等多个环节，每个环节都存在着可能危害消费者的风险。安全的药品是人们认为它对人体损害的风险程度在可接受的水平，是一种“可接受”的有临床疗效的药品。药品安全是一个相对的概念，取决于上市前对药品安全评价的认知局限性，也取决于对药品风险与收益量化评价的艰难性。药品安全相对性体现在整个药品的研发过程中。在这个过程中，不追求“零风险”，而要求对风险的有效控制，使其控制在可接受的范围内。药品的最终上市是利益与风险权衡的结果。药品安全风险客观存在，这主要是由于药品具有两重性，一方面可以防病治病，另一方面也可能引起不良反应，使用不当会危害人体健康。任何药品的安全性都是相对的，药品本身就具有不可避免的安全风险（A对）。药品安全风险可分为自然风险和人为风险。药品安全的自然风险，又称“必然风险”“固有风险”，是药品的内在属性，属于药品设计风险。药品安全的自然风险是客观存在的，和药品的疗效一样，是由药品本身所决定的，来源于已知或者未知的药品不良反应。药品安全的人为风险，属于“偶然风险”的范畴，是指人为有意或无意违反法律法规而造成的药品安全风险，存在于药品的研制、生产、经营、使用各个环节。人为风险属于药品的制造风险和使用风险，主要来源于不合理用药、用药差错、药品质量问题、政策制度设计及管理导致的风险，是我国药品安全风险的关键因素（B对）。风险管理原则是全球药品管理的第一原则。风险通常被认为是“危害发生的可能性及其严重性的组合”，风险是与安全相对立统一的概念，风险存在一个可接受可容忍的“阈值”。药品领域风险来源多样，没有绝对安全的药品，只有不断地防控各种风险，才能实现保护和促进公众健康的目的。药品安全风险管理的目的在于使药品风险最小化，从而保障公众用药安全。药品安全管理就是药品安全的风险管理，最核心的要求就是要将事前预防、事中控制、事后处置有机结合起来，坚持预防为先，发挥多元主体作用，落实好各方责任，形成全链条管理，切实把药品安全风险管控起来。《药品管理法》第三条规定了药品管理坚持风险管理的原则。药品安全风险管理是一项非常复杂的社会系统工程，需要全社会共同参与，需要多方合作和充足的资源，需要明确药品研发机构、生产企业、经营企业和使用单位等风险管理主体的责任。药品安全管理的主要措施：药品管理应当以人民健康为中心，坚持风险管理、全程管控、社会共治的原则，建立科学、严格的监督管理制度，落实“四个最严”，即最严谨的标准、最严格的监管、最严厉的处罚和最严肃的问责，全面提升药品质量，保障药品的安全、有效、可及。在我国，加强药品安全风险管理可以从四个方面着手：首先，需要健全药品安全监管的各项法律法规。现有的对药品上市前的注册审评、药品上市后的不良反应监测，以及对存在安全隐患的药品实行召回、对已上市药品进行再评价等法律法规，是我国药品安全风险管理的法律基础；应当将风险管理的理念融入立法当中，完善法律法规、规范性文件和指南等，以覆盖药品安全风险管理的全过程，从而对药品整个生命周期中的风险进行全程监控。其次，要完善药品安全监管的相关组织体系建设。国家药品监督管理局设有药品注册管理司、药品监督管理司，以及药品审评中心、药品评价中心（国家药品不良反应监测中心）、执业药师资格认证中心等机构，形成了我国药品安全监管的行政和技术支撑体系。再者，要加强药品研制、生产、经营、使用环节的全过程管理，落实药品安全管理参与方各自的责任。药品上市许可持有人要始终以保护公众健康为中心，依法对药品研制、生产、经营、使用全过程中药品的安全性、有效性和质量可控性负责，承担药品全生命周期质量与风险管理的主体责任（C对）。最后，要建立药品追溯系统，所有药品上市许可持有人、生产企业、经营企业、使用单位都应当通过信息化手段建立这一系统，实现“一物一码，物码同追”，及时准确记录、保存药品追溯数据，形成互联互通药品追溯数据链，实现药品生产、流通和使用全过程来源可查、去向可追；有效防范非法药品进入合法渠道；确保发生质量安全风险的药品可召回、责任可追究。